某女，42岁，患慢性宫颈炎数年，症见带下量多，色黄粘稠，臭秽，小腹疼痛，腰骶酸疼，神疲乏力。治当清热除湿、益气化瘀。宜选用的成药是
A. 坤宝丸
B. 消糜栓
C. 花红片
D. 妇科千金片
E. 保妇康泡沫剂

正确答案：D。妇科千金片

解析：本题考查的是妇科千金片的主治。患慢性宫颈炎数年，症见带下量多，色黄粘稠，臭秽，小腹疼痛，腰骶酸疼，神疲乏力。治当清热除湿、益气化瘀。宜选用的成药是妇科千金片（D对）。妇科千金片：【主治】湿热瘀阻所致的带下病、腹痛，症见带下量多、色黄质稠、臭秽、小腹疼痛、腰骶酸痛、神疲乏力；慢性盆腔炎、子宫内膜炎、慢性宫颈炎见有上述证候者。坤宝丸（A错）：【主治】肝肾阴虚所致的绝经前后诸证，症见烘热汗出、心烦易怒、少寐健忘、头晕耳鸣、口渴咽干、四肢酸楚；更年期综合征见上述证候者。消糜栓（B错）：【主治】湿热下注所致的带下病，症见带下量多、色黄、质稠、腥臭、阴部瘙痒；滴虫性阴道炎、霉菌性阴道炎、非特异性阴道炎、宫颈糜烂见有上述证候者。花红片（C错）：【主治】湿热瘀滞所致带下病、月经不调，症见带下量多、色黄质稠、小腹隐痛、腰骶酸痛、经行腹痛；慢性盆腔炎、附件炎、子宫内膜炎见有上述证候者。保妇康泡沫剂（E错）：【主治】湿热瘀滞所致的带下病，症见带下量多、色黄，时有阴部瘙痒；霉菌性阴道炎、老年性阴道炎、宫颈糜烂见有上述证候者。